火麻仁除润肠通便外，又能
A. 下乳
B. 补虚
C. 清肺化痰
D. 凉血止血
E. 燥湿化痰

正确答案：B。补虚

解析：本题考查的是火麻仁的功效。火麻仁除润肠通便外，又补虚（B对）。火麻仁：【功效】润肠通便。火麻仁甘平油润，又兼补虚。冬葵子：【功效】利水通淋，下乳（A错），润肠通便。瓜蒌：【功效】清肺润燥化痰（C错），利气宽胸，消肿散结，润肠通便。石韦：【功效】利尿通淋，凉血止血（D错），清肺止咳。陈皮：【功效】理气调中，燥湿化痰（E错）。